有关小儿肠道菌群建立的论述，正确的是
A. 肠道菌群受食物成分影响
B. 母乳喂养以大肠杆菌为主
C. 出生＞24小时后肠道开始出现细菌
D. 肠道菌群可以合成维生素D
E. 人工喂养者以双歧杆菌为主

正确答案：A。肠道菌群受食物成分影响

解析：肠道菌群受食物成分影响较大（A对）：人工喂养者以大肠杆菌为主（B错），母乳喂养以双岐杆菌为主（E错）。小儿出生数小时后即可出现细菌，不用等到24小时后（C错）。肠道菌群可以合成维生素B和维生素E，但不能合成维生素D（D错）。